某男，75岁。小便点滴而下，尿如细线，烦躁口苦，舌紫暗苔黄腻，脉涩。四诊合参，病机属于
A. 湿热瘀阻
B. 湿热下注
C. 结石瘀血
D. 热盛津伤
E. 阴虚火旺

正确答案：A。湿热瘀阻

解析：本题考查的是癃闭的辨证论治。小便点滴而下，尿如细线，烦躁口苦，舌紫暗苔黄腻，脉涩。四诊合参，病机属于湿热瘀阻（A对）。癃闭湿热瘀阻证：【症状】小便点滴而下，或尿如细线，甚则阻塞不通，烦躁口苦。舌质紫暗或有瘀点，舌苔黄腻，脉涩。湿热下注（B错）为痔的辨证。痔湿热下注证：【症状】内痔可见便血色鲜红，量较多，肛内肿物外脱，可自行回缩，肛门灼热。外痔可见肛缘肿物隆起，灼热疼痛，咳嗽、行走、坐位均可使疼痛加剧，便干或溏，溲赤。舌质红，苔黄腻，脉弦数。热盛津伤（D错）：可见舌质红绛而有裂纹，糙苔，小便短少。阴虚火旺（E错）为心悸阴虚火旺证的辨证论治。心悸阴虚火旺证：【症状】心悸易惊，心烦失眠，五心烦热，口干，盗汗，思虑劳心则症状加重，伴耳鸣腰酸，头晕目眩，急躁易怒。舌红少津，苔少或无，脉细数。结石瘀血（C错）：结石，指体内某些部位形成并停滞为病的砂石样病理产物或结块。常见的结石有泥砂样结石、圆形或不规则形状的结石、结块样结石（如胃结石）等，且大小不一。一般来说，结石小者，易于排出；而结石较大者，难于排出，多留滞而致病。瘀血，是指体内局部血液的停滞，包括离经之血积存体内，或血运不畅，阻滞于经脉、脏腑及其他部位的血液，均称为瘀血。